能够引起宿主致病的各种生物体，包括：病毒、细菌、真菌和寄生虫等，称为
A. 宿主
B. 感染过程
C. 感染谱
D. 病原体
E. 传染源

正确答案：D。病原体

解析：病原体：指能够引起宿主致病的各种生物体，包括：病毒、细菌、真菌和寄生虫等。掌握“传染病预防及控制”知识点。